肠易激综合征的症状特点是
A. 腹痛腹胀等症状与排便无关
B. 病史较长者会出现营养不良
C. 精神紧张者可使症状加重
D. 常有便失禁
E. 夜间入睡后仍会出现腹泻

正确答案：C。精神紧张者可使症状加重

解析：精神心理因素对肠易激综合征患者的临床表现有很大的影响，精神紧张者可使症状加重（C对）。肠易激综合征患者腹痛腹胀等症状于排便后缓解（A错）。本病起病隐匿，症状反复发作或慢性迁延，病程可长达数年至数十年，但全身健康状况却不受影响（B错）。便失禁见于神经系统受损或者肛门扩约肌受损，肠易激综合征无器质性病变，不会出现便失禁（D错）。肠易激综合征患者不会影响睡眠，夜间入睡后不会出现腹泻（E错）。